BOD表示
A. 水体中可被分解的有机物的总量
B. 需氧微生物分解有机物消耗水中溶解氧的量
C. 易被分解的有机物的含量
D. 水体中所有有机物的量
E. 用强氧化剂氧化水中有机物所消耗的氧量

正确答案：B。需氧微生物分解有机物消耗水中溶解氧的量

解析：本题考查BOD。BOD即生化需氧量，指需氧微生物分解有机物消耗水中溶解氧的量（B对ACDE错）。